下列疾病中，持续性干咳而胸部X线片正常的情况最常见于
A. 支气管哮喘
B. 慢性支气管炎
C. 心力衰竭
D. 支气管扩张
E. 支气管结核

正确答案：A。支气管哮喘

解析：支气管哮喘（A对）的典型症状为发作性伴有哮鸣音的呼气性呼吸困难，还存在没有喘息症状的不典型哮喘，以咳嗽为唯一症状的不典型哮喘称为咳嗽变异性哮喘，支气管哮喘病人的胸部X线平片多无明显异常，仅在发作期出现肺透亮度增加。慢性支气管炎（B错）以咳嗽、咳痰为主要症状，或伴有喘息，胸部X线平片示肺纹理增粗、紊乱，呈网状或条索状改变，以双下肺野明显（P19-P20）。心力衰竭（C错）的患者有呼吸困难、咳嗽、咳痰、咯血等症状，且胸部X线平片可见KerleyB线等慢性肺淤血的表现（P167-P169）。支气管扩张（D错）以咳嗽、咳脓痰为主要临床表现，X线平片检查示囊状支气管扩张的气道表现为显著的囊腔，腔内可存在气液平面（P37）。支气管结核（E错）主要以咳嗽以及发热、盗汗等为主要临床表现，肺部X线可呈浸润、增殖、干酪、纤维钙化病变可同时存在，密度不均匀、边缘较清楚的病灶（P65）。